氨基苷类药物在体内分布浓度较高的部位是
A. 细胞内液
B. 血液
C. 耳蜗内淋巴液
D. 脑脊液
E. 结核病灶的空洞中

正确答案：C。耳蜗内淋巴液